患者女，35岁，平素情志抑郁，近来表情淡漠，神志呆钝，语无伦次，喜怒无常，不思饮食，舌苔白腻，脉象弦滑。治疗方药宜选用
A. 生铁落饮
B. 二阴煎
C. 养心汤
D. 黄连温胆汤
E. 顺气导痰汤

正确答案：E。顺气导痰汤

解析：患者精神抑郁，表情淡漠，神志呆钝，语无伦次，故诊断为癫证；本病常由于思虑太过，所求不得，肝气被郁，脾气不升，气郁痰结，阻蔽神明，故表现出精神抑郁，表情淡漠，神志痴呆，语无伦次这些精神异常的证候；痰浊中阻，故不思饮食；舌苔白腻，脉象弦滑为痰气郁结之候，证为癫证之痰气郁结证型。顺气导痰汤，其功用为涤痰开窍，与逍遥散合用，可用于治疗痰气郁结证（E对）。生铁落饮，其功用为清心泻火，涤痰醒神，适用于治疗狂证之痰火扰神证（A错）。二阴煎用于治疗癫证火盛伤阴证（B错）。养心汤为癫证心脾两虚证型的选方（C错）。黄连温胆汤用治癫证痰气郁结证之痰郁化热（D错）。